下列属于补体系统缺陷导致的疾病是
A. 急性肾小球肾炎
B. 过敏性休克
C. 接触性皮炎
D. 遗传性血管神经性水肿
E. 桥本甲状腺炎

正确答案：D。遗传性血管神经性水肿

解析：血浆中一些调控蛋白调节着补体系统的活性，它们的缺陷可产生相应的临床症状。C1抑制物（C1INH）缺陷可导致遗传性血管神经性水肿（D对）。急性肾小球肾炎（A错）主要为β-溶血性链球菌感染诱发的免疫反应所致；过敏性休克（B错）是由 IgA 同种免疫、异型变异原、不同个体间 IgG 重链抗原性存在差异等引起的；接触性皮炎（C错）是皮肤或黏膜单次或多次接触外源性物质后，在接触部位甚至以外的部位发生的炎症性反应；桥本甲状腺炎（E错）属于自身免疫性甲状腺病，是血清存在针对甲状腺的自身抗体，甲状腺存在浸润的淋巴细胞所致。